治疗胃痛，循经取穴可取
A. 内关
B. 合谷
C. 足三里
D. 三阴交
E. 丰隆

正确答案：C。足三里

解析：足三里与丰隆均为胃经穴位，但足三里是胃经下合穴，“合治内腑”， 可疏调胃腑气机，和胃止痛，用于治疗腑病，首选足三里（C对）。内关归属于心包经（A错）。合谷归属大肠经（B错）。三阴交归属于脾经（D错）。丰隆归属胃经，主治头痛眩晕；癫狂；咳嗽、痰多等痰饮病证；下肢痿痹；腹胀、便秘（E错）。